患者因多个牙楔状缺损复合树脂充填后不敢咬物，冷热刺激疼痛，去除刺激可缓解，其原因可能为
A. 充填材料对牙髓组织的化学刺激
B. 备洞过程中产热
C. 继发龋
D. 充填时牙面未干燥
E. 酸蚀后牙面又污染

正确答案：A。充填材料对牙髓组织的化学刺激

解析：本题考查充填后疼痛。患者因多个牙楔状缺损复合树脂充填后不敢咬物，冷热刺激疼痛，去除刺激可缓解，其原因可能为充填材料对牙髓组织的化学刺激（A对）。复合树脂未垫底直接充填，其化学刺激可激惹牙髓，导致牙髓充血，出现激发痛，该患者因多个牙楔状缺损复合树脂充填后不敢咬物，冷热刺激疼痛，去除刺激可缓解，其原因可能为充填材料对牙髓组织的化学刺激。备洞过程中产热也可激惹牙髓，在楔状缺损充填修复时会适当修整楔缺边缘，涡轮机修整时间较短，其对牙髓的刺激较小，病例中由备洞产热导致牙髓充血的可能性较低（B错）。继发龋主要导致远期的牙髓性疼痛，不会充填后就有明显的冷热刺激痛（C错）。充填时牙面未干燥和酸蚀后牙面又污染会导致充填体粘接不牢固，易脱落（DE错）。